主要由于免疫因素异常引起溶血性贫血的情况是
A. 大面积烧伤
B. 疟疾
C. 血型不合的输血
D. 人工心脏瓣膜置换术后
E. 毒蛇咬伤

正确答案：C。血型不合的输血

解析：引起溶血性贫血的免疫性因素主要有温抗体型或冷抗体型（冷凝集素型、D-L抗体型）HA、SLE（系统性红斑狼疮）、病毒、药物、血型不符的输血（C对）、新生儿HA等。大面积烧伤（A错）为理化因素。疟疾（B错）和毒蛇咬伤（E错）为生物因素。人工心脏瓣膜置换术后（D错）为血管性因素。